患者微恶风寒，发热重，浊涕，痰稠或黄，咽喉肿痛，苔薄黄，脉浮数治疗取大椎穴，宜采用的刺灸法是
A. 刺络拔罐法
B. 毫针捻转补法
C. 毫针提插补法
D. 毫针平补平泻法
E. 温针灸

正确答案：A。刺络拔罐法

解析：刺络拔罐疗法主要是采用针刺穴位同时配合拔火罐，利用罐内空气形成的负压，拔吸在人体表面穴位或治疗部位上，对局部皮肤形成吸拔，从而造成局部皮肤充血，淤血或气泡，以此来达到治疗疾病、改善身体疲劳等效果。临床治疗感冒、发热、头痛、头晕、风痹、腰痛、四肢痛等。该患者恶寒，发热，流涕，咽痛，脉浮，为感冒之象，而微恶风寒，发热重，浊涕，痰稠或黄，苔黄，脉数为风热之象，为风热之邪犯表、肺气失和所致，可用刺络拔罐法发汗解表，驱散风热（A对）。风热感冒为外邪侵犯肺卫所致，除针刺列缺、合谷、风池、太阳、外关等穴外，还可在尺泽、耳尖、少商等处点刺放血，在大椎刺络拔罐放血。